金刚烷胺作用于
A. M受体
B. β受体
C. 5-HT受体
D. 多巴胺受体
E. 苯二氮䓬受体

正确答案：A。M受体

解析：本题考查金刚烷胺。金刚烷胺作用于M受体（A对）。金刚烷胺主要是通过抑制甲型流感病毒的非糖基化基质蛋白M₂蛋白的离子通道来抑制病毒脱壳和复制，通过影响血凝素而干扰病毒组装，只对亚洲甲型流感病毒有抑制作用（因乙型流感病毒不携带M₂蛋白，故无效）。作用于β受体（B错）的药物异丙肾上腺素、沙丁胺醇、特布他林等，用于治疗支气管哮喘。作用于5-HT受体（C错）的药物有舍曲林、西酞普兰等，为抗抑郁药。作用于多巴胺受体（D错）的药物有甲氧氯普胺等，为胃肠动力药。作用于苯二氮䓬受体（E错）的药物有地西泮、氟西泮等，为镇静催眠药。